患者，女，24岁。因外伤导致膀胱破裂，现面色苍白，呼吸急促，四肢厥冷，烦躁不安，脉细数；查体：血压90/70mmHg，心率155次/分。考虑为
A. 感染性休克
B. 创伤性休克早期
C. 创伤性休克代偿期
D. 失液性休克
E. 心源性休克

正确答案：B。创伤性休克早期

解析：患者创伤性休克多见于严重的外伤（患者为外伤导致膀胱破裂），从而导致的有效循环血容量减少，出现面色苍白，呼吸急促，四肢厥冷，烦躁不安，脉细数，血压降低，心率增快，出现休克症状体征，所以考虑为创伤性休克。感染性休克主要表现为血压下降，和器官组织灌注不足，常见症状是意识障碍、少尿、血压下降且伴随多器官损害（A错）。创伤性休克早期由于机体对有效循环血量减少的早期，有相应的代偿能力，引起中枢神经系统性兴奋性抬高，引起精神紧张，烦躁不安，皮肤苍白，心率加快，呼吸加快，尿量减少等症状（B对C错）。心源性休克失液性休克因血容量不足超过了代偿功能，表现为面色苍白、冷汗、虚脱、脉搏细弱、呼吸不畅，此外患者出现口渴、尿量减少或无尿、四肢湿冷等，重者烦躁不安、昏迷（D错）。心源性休克症状包括烦躁不安、恐惧和精神紧张，意识模糊，肢端湿冷、大汗、心律呼吸增快、恶心、呕吐等（E错）。